男，70岁。饮酒1小时后呕咖啡样物100ml，后排黑便100g。既往体健。查体：P110次/分，BP90/50mmHg。对诊断及治疗最有意义的检查是
A. 胃镜
B. 腹部X线平片
C. 上消化道X线钡餐造影
D. 腹部B超
E. 腹部CT

正确答案：A。胃镜

解析：患者老年男性，饮酒l小时后呕咖啡样物100ml，后排黑便100g，BP90/50mmHg，提示有上消化道出血（呕血和黑便是上消化道出血的特征性表现）。不论选用纤维胃镜或电子胃镜（A对），均作为确诊消化性溃疡的主要方法。在内镜直视下，消化性溃疡通常呈圆形、椭圆形或线形，边缘锐利，基本光滑，为灰白色或灰黄色苔膜所覆盖，周围黏膜充血、水肿，略隆起。上消化道X线钡餐造影（C错）也可诊断上消化道出血的方法，在内镜未能做出有效诊断时使用。腹部X线平片（B错）、腹部B超（D错）、腹部CT（E错）同X线钡餐造影，均不作为首选，但有助于了解病情与病因诊断。影像学X线钡剂造影有助于发现肠道憩室及较大的隆起或凹陷样肿瘤。腹部CT对于有腹部包块、肠梗阻征象的患者有一定的诊断价值。